产地加工时，用微火烘至半干，堆置“发汗”至内部变绿色时，再烘干的是
A. 黄芩
B. 当归
C. 续断
D. 香附
E. 射干

正确答案：C。续断

解析：本题考查的是续断的采收加工。产地加工时，用微火烘至半干，堆置“发汗”至内部变绿色时，再烘干的是续断（C对）。续断：【采收加工】秋季采挖，除去根头和须根，用微火烘至半干，堆置“发汗”至内部变绿色时，再烘干。黄芩（A错）：【采收加工】春、秋二季采挖，除去须根及泥沙，晒至半干，撞去粗皮，晒干。当归（B错）：【采收加工】一般栽培至第2年秋末采挖，除去茎叶、须根及泥土，放置，待水分稍蒸发后根变软时，捆成小把，上棚，以烟火慢慢熏干。香附（D错）：【采收加工】秋季采挖，燎去毛须，置沸水中略煮或蒸透后晒干，或燎后直接晒干。射干（E错）：【采收加工】春初刚发芽或秋末茎叶枯萎时采挖，除去须根和泥沙，干燥。